肝病慎用的药
A. 谷氨酸
B. 门冬氨酸钾镁
C. 氯丙嗪
D. 甘草酸二铵
E. 泛酸钙

正确答案：C。氯丙嗪

解析：本题考查肝病慎用药。肝病患者慎用会对肝脏产生影响、加重肝脏负担的药物，如阿司匹林类药物及氯丙嗪（C错，为本题正确答案）。